保健食品的功能不包括
A. 治疗疾病
B. 增强免疫力
C. 辅助降血脂
D. 减肥
E. 缓解体力疲劳

正确答案：A。治疗疾病

解析：本题考查保健食品的功能。保健食品是指声称具有特定保健功能或者以补充维生素、矿物质为目的的食品。即适于特定人群食用，具有调节机体功能，不以治疗疾病为目的（A错，为本题正确答案），并且对人体不产生任何急性、亚急性或者慢性危害的食品。其功能包括：增强免疫力（B对）、辅助降血糖/降血脂（C对）、抗氧化、减肥（D对）、促进生长发育、缓解体力疲劳（E对）等。